女，70岁。外阴、阴道灼热感4天。妇科检查：阴道粘膜有散在出血点，阴道内少许分泌物，呈淡黄色，其最可能的病因是
A. 雌激素水平低下
B. 淋菌感染
C. 阴道菌群失调
D. 念珠菌感染
E. 滴虫感染

正确答案：A。雌激素水平低下

解析：该患者70岁，年龄大，外阴、阴道灼热感4天，阴道粘膜有散在出血点，阴道内少许分泌物，呈淡黄色，该患者首先考虑的诊断为萎缩性阴道炎。绝经后妇女因卵巢功能衰退，雌激素水平降低，阴道壁萎缩，黏膜变薄，上皮细胞内糖原减少，阴道pH增高，阴道抵抗力下降所致。故最可能的病因是雌激素水平低下（A对）。淋菌感染（B错）是淋病的病因。阴道菌群失调（C错）是细菌性阴道病的病因。念珠菌感染（D错）是外阴阴道假丝酵母菌病的病因。滴虫感染（E错）是滴虫阴道炎的病因。